下列关于职业卫生标准论述错误的是
A. 对职业有害因素规定的接触限值
B. 超过限值与否是诊断职业病的依据
C. 是衡量作业卫生状况的尺度、改善劳动条件的目标
D. 实施卫生监督的依据
E. 其目的是保护劳动者健康

正确答案：B。超过限值与否是诊断职业病的依据